北沙参的别名是
A. 紫河车
B. 草河车
C. 空沙参
D. 东沙参
E. 潞党参

正确答案：D。东沙参

解析：本题考查的是常见的中药正名与相关别名。北沙参的别名是东沙参（D对）。北沙参别名：辽沙参、东沙参、莱阳沙参。紫河车（A错）为药材正名。草河车（B错）为重楼的别名。重楼的别名有七叶一枝花、蚤休、草河车。空沙参（C错）为南沙参的别名。南沙参别名：泡沙参、空沙参、白沙参、白参。潞党参（E错）为党参的别名。党参别名：潞党参、台党参、防参。